谷类食品保留哪部分容易引起食物的变质
A. 胚
B. 胚乳
C. 谷皮
D. 吸收层
E. 糊粉层

正确答案：A。胚